具有燥湿健脾，祛风湿，发汗，明目功效的药物是
A. 苍术
B. 厚朴
C. 藿香
D. 佩兰
E. 砂仁

正确答案：A。苍术

解析：该题考查的是苍术的功效，属记忆内容。苍术味辛、苦，性温，入脾、胃、肝经，具有燥湿健脾，祛风散寒的功效，苍术辛香燥烈，能开肌凑而发汗，祛肌表之风寒表邪，并且具有明目的功效，用于夜盲症及眼目昏涩（A对）。厚朴，藿香，佩兰，砂仁皆为化湿药，没有发汗，明目的功效（BCDE错）。